药用部位为动物排泄物的药材是
A. 阿胶
B. 五灵脂
C. 牛黄
D. 牡蛎
E. 熊胆粉

正确答案：B。五灵脂

解析：本题考查的是动物药的常用药用部位。药用部位为动物排泄物的药材是五灵脂（B对）。常用动物类中药的药用部位有：1.动物的干燥整体。如水蛭、全蝎、蜈蚣、斑蝥、土鳖虫、虻虫、九香虫等。2.除去内脏的动物体。如地龙、蛤蚧、乌梢蛇、蕲蛇、金钱白花蛇等。3.动物体的某一部分。角类：如鹿茸、鹿角、羚羊角、水牛角等；鳞、甲类：如龟甲、鳖甲等；骨类：如豹骨、狗骨、猴骨等；贝壳类：如石决明、牡蛎（D错）、珍珠母、海螵蛸、蛤壳、瓦楞子等；脏器类：如哈蟆油、鸡内金、鹿鞭、海狗肾、水獭肝、刺猬皮等。4.动物的生理产物。分泌物：如麝香、蟾酥、熊胆粉（E错）、虫白蜡、蜂蜡等；排泄物：如五灵脂、蚕砂、夜明砂等；其他生理产物：如蝉蜕、蛇蜕、蜂蜜、蜂房等。5.动物的病理产物。如珍珠、僵蚕、牛黄（C错）、马宝、猴枣、狗宝等。6.动物体某一部分的加工品。如阿胶（A错）、鹿角胶、鹿角霜、龟甲胶、血余炭、水牛角浓粉等。